发热的高峰期可出现
A. 产热正常，散热减少
B. 产热增多，散热减少
C. 产热与散热都增多
D. 产热减少，散热减少
E. 产热减少，散热增多

正确答案：C。产热与散热都增多

解析：当体温升高到调定点的新水平时，便不再继续上升，而是在这个与新调定点相适应的高水平上波动，所以称高温持续期，也称高峰期或稽留期。产热与散热都增多（C对）是此期的热代谢特点。产热增多，散热减少（B错）是体温上升期的热代谢特点。产热减少，散热增多（E错）是退热期的热代谢特点。在发热过程的三个时期中一般没有A、D选项的相关说法。